慢性肝病患者慎用的药品是
A. 辅酶A
B. 异烟肼
C. 法莫替丁
D. 硝苯地平
E. 地高辛

正确答案：B。异烟肼

解析：本题考查特殊人群用药。慢性肝病患者慎用的药品是异烟肼（B对）。异烟肼可致代谢性肝损伤，肝病患者慎用。辅酶A（A错）可用于急慢性肝炎的治疗。法莫替丁（C错）、硝苯地平（D错）对肝肾功能不全者慎用。地高辛（E错）慎用人群：低钾血症、高钙血症患者、甲状腺功能低下患者、窦房结病变患者、部分心脏传导阻滞患者、急性心肌炎、急性心肌梗死和高度心力衰竭患者及严重肺部疾病患者。